适用于阳偏衰的治法是
A. 阳中求阴
B. 阳病治阴
C. 热因热用
D. 阴病治阳
E. 热者寒之

正确答案：D。阴病治阳

解析：阴阳互根的意义，在于阴阳始终处于统一体之中，每一方都以对方的存在作为自身存在的前提和条件，任何一方都不能脱离对方而单独存在（A错）。对“阴虚则热”所出现的虚热证，治宜滋阴以抑阳，即王冰所谓“壮水之主，以制阳光”。《素问》称之为“阳病治阴”（B错）。热因热用即以热治热，是指用温热方药或具有温热功效的措施来治疗具有假热征象的治法适用于真寒假热证，即阴寒内盛，格阳于外，形成里真寒外假热的病证（C错）。对“阳虚则寒”所出现的虚寒证，治宜扶阳以抑阴，即王冰所谓“益火之源，以消阴翳”。《素问·阴阳应象大论》称之为“阴病治阳”（D对）。对“阳胜则热”所致的实热证，宜用寒凉药物以清泻其偏盛之阳热，此即“热者寒之”之法（E错）。